缺铁性贫血患者需注意铁剂与其他药物之间的相互作用，可促进口服铁剂吸收的药物是
A. 叶酸
B. 维生素B₁
C. 维生素B₁₂
D. 维生素B₆
E. 维生素C

正确答案：E。维生素C

解析：本题考查缺铁性贫血的患者教育。维生素C显酸性而且具有还原性，可促进铁剂吸收。